患者，男，23岁。右前臂内侧有红丝一条，向上走窜，停于肘部。用砭镰疗法的操作要点是
A. 沿红线两头，针刺出血
B. 梅花针沿红线叩刺，微微出血
C. 用三棱针沿红线寸寸挑断，并微微出血
D. 用三棱针点刺出血
E. 梅花针沿红线叩刺，微微出血，并加神灯照法

正确答案：C。用三棱针沿红线寸寸挑断，并微微出血

解析：右前臂内侧有红丝一条，向上走窜，停于肘部诊断为淋巴管炎，可用三棱针沿红线寸寸挑断，并微微出血（C对ABDE错）。